预测Graves病停用抗甲状腺药物是否易复发的指标是
A. 甲状腺摄¹³¹I率
B. 抗甲状腺抗体
C. TSH
D. T₃、T₄及rT₃
E. 甲状腺刺激免疫球蛋白

正确答案：E。甲状腺刺激免疫球蛋白

解析：Graves病的发生与自身免疫因素有关，其主要特征为血清中TSH受体刺激性抗体即甲状腺刺激免疫球蛋白含量增加。甲状腺刺激免疫球蛋白（E对）与TSH受体结合，激活腺苷酸环化酶信号系统，导致甲状腺细胞增生和甲状腺激素合成、分泌增加，引起甲亢，其主要用于评价抗甲状腺药物治疗的疗效、确定停药时机、预测复发等。ATD的最佳停药指标是甲状腺功能正常和TRAb阴性。甲状腺摄¹³¹I率（A错）测定主要用于甲状腺毒症病因的鉴别。抗甲状腺抗体（B错）检测主要用于甲亢治疗的选择和预后的判断。TSH（C错），T₃、T₄及FT₃（D错）是诊断甲亢最重要的指标，主要反映甲状腺的功能，但不是预测Graves病是否易复发的指标。